含无机盐较多的植物类中药材，灰分测定时需要测定
A. 总灰分
B. 生理性灰分
C. 酸不溶性灰分
D. 炽灼残渣
E. 灰屑含量

正确答案：C。酸不溶性灰分